浴池业卫生应将工具用品的消毒放在首位，在消毒方法或药剂选择上以哪项为主
A. 消灭细菌
B. 消灭病毒
C. 消灭真菌
D. 消灭细菌和病毒
E. 消灭细菌和寄生虫

正确答案：C。消灭真菌

解析：本题考查浴池业的卫生要求。浴池业卫生应将工具、用品的消毒放在首位，在消毒方法或药剂选择上以消灭真菌（C对ABDE错）为主。